枕骨大孔疝的临床表现不包括
A. 昏迷
B. 呕吐
C. 颈项强直
D. 双侧瞳孔大小多变
E. 尿崩

正确答案：E。尿崩

解析：枕骨大孔疝又称小脑扁桃体疝，指由于颅内压增高，使小脑扁桃体及延髓经枕骨大孔推挤向椎管内。发生枕骨大孔疝时，由于脑脊液循环通路被堵塞，病人可出现剧烈头痛、呕吐（B对）等颅内压增高的表现；延髓下移牵拉颈神经根，可引起颈后部疼痛、颈项强直（C对）；由于脑干受压，早期可出现生命体征紊乱，晚期可出现昏迷（A对）；因脑干缺氧，双侧瞳孔可忽大忽小（D对）。尿崩（九版内科学P673）是指精氨酸加压素（AVP）又称抗利尿激素（ADH）缺乏（称中枢性尿崩症），或肾脏对AVP不敏感（肾性尿崩症），导致肾小管重吸收水的功能障碍，从而引起多尿、烦渴、多饮与低比重尿和低渗尿为特征的一组临床综合征，常见于青壮年。中枢性尿崩多由下丘脑神经垂体及附近部位的肿瘤引起。枕骨大孔疝时一般不会损伤下丘脑或神经垂体而引起中枢性尿崩，更不会因累及肾脏而导致肾性尿崩（E错，为本题正确答案）。